肝阳化风可见
A. 眩晕欲仆
B. 目睛上吊
C. 手足蠕动
D. 手足拘挛不伸
E. 皮肤瘙痒

正确答案：A。眩晕欲仆

解析：肝阳化风，肝风内旋，上扰头目，则眩晕欲仆（A对）。目睛上吊见于热极生风（B错）。手足蠕动常见于阴虚风动（C错）。手足拘挛不伸见于血虚生风（D错）。皮肤瘙痒见于血燥生风（E错）。